社区健康教育与健康促进的策略是
A. 开发领导，实现行政干预
B. 动员社会力量，建立健全组织网络
C. 依靠家庭力量，实施健康教育
D. 开发利用社区人力资源、财力资源、物力资源、信息资源
E. 以上都是

正确答案：E。以上都是